男性，40岁。低热，乏力伴消瘦1个月，查体：右颈部锁骨下淋巴结肿大，CT示中纵隔伴右侧肺门实性肿物，纵隔淋巴结广泛肿大，血常规检查未见异常。确诊的最佳方法是
A. CT引导下细针穿刺活检
B. 颈部淋巴结活检
C. 肺部增强CT
D. 胸部彩超
E. 剖胸探查

正确答案：B。颈部淋巴结活检

解析：患者考虑为淋巴瘤，应首选颈部淋巴结活检（B对）予以确诊。CT引导下细针穿刺活检（A错）操作较为复杂，剖胸探查（E错）为有创检查，均不是最佳选择；肺部增强CT（C错）常用于肺部肿瘤的诊断；胸部彩超（D错）对淋巴瘤的无诊断价值。